上皮浅层破坏，未侵犯上皮全层的病变是
A. 疱
B. 溃疡
C. 斑
D. 糜烂
E. 角化不良

正确答案：D。糜烂

解析：本题考查口腔黏膜疾病的临床基本病损。上皮浅层破坏，未侵犯上皮全层的病变是糜烂（D对）。疱（A错）：黏膜内贮存液体而成疱性病损，疱损直径小于1cm。溃疡（B错）：是黏膜上皮的完整性发生连续性缺损或破坏，因其表层坏死脱落而形成凹陷。斑（C错）：黏膜固有层血管增生，扩张及充血形成的病变。角化不良（E错）：指表皮或附属器个别角质形成细胞未至角质层，即显示过早角化。